以铁蛋白和含铁血黄素存在的铁属于
A. 血红素铁
B. 非血红素铁
C. 血红素铁和非血红素铁
D. 功能性铁
E. 贮存铁

正确答案：E。贮存铁